男，68岁。排便时诉胸闷，随即跌倒，呼之不应，皮肤发绀。最有助于确诊心脏骤停的临床表现是
A. 意识丧失
B. 呼吸停止
C. 皮肤发绀
D. 心音消失
E. 桡动脉搏动消失

正确答案：D。心音消失

解析：老年男性患者，排便时诉胸闷，随即跌倒，呼之不应，皮肤发绀（心脏骤停表现）。此时最有助于判断心脏骤停的临床表现是心音消失（D对）。意识丧失可能是脑部突然缺血导致，不一定是心脏骤停所致（A错）。呼吸停止有可能是呼吸系统功能障碍所致（B错）。皮肤发绀有可能是组织缺氧所致导致缺氧原因多样（C错）。桡动脉搏动消失可见于休克等（E错）。